A1DS发生卡泊西肉瘤主要是由于
A. 巨细胞病毒感染
B. 弓形体感染
C. 肺孢子菌感染
D. 人疱疹病毒8感染
E. 隐孢子虫感染

正确答案：D。人疱疹病毒8感染

解析：卡波西肉瘤主要是由于人疱疹病毒8感染（D对），在艾滋病患者中较为常见，多见于男同性恋及男双性恋患者，也可见于静脉吸毒者。病变主要累及下肢皮肤和口腔黏膜、出现紫红色和深蓝色浸润斑或结节，并可发生糜烂、溃疡。这种恶性病变也可出现于淋巴结和内脏。确诊有赖于病理活检。